零售药店，必须凭执业医师或执业助理医师处方销售的是
A. 一类精神药品
B. 处方药
C. 非处方药
D. 甲类非处方药
E. 乙类非处方药

正确答案：B。处方药

解析：本题考查处方药。零售药店，必须凭执业医师或执业助理医师处方销售的是处方药（B对）。零售药店不得经营的九大类药品：麻醉药品、放射性药品、一类精神药品（A错）、终止妊娠药品、蛋白同化制剂、肽类激素（胰岛素除外）、药品类易制毒化学品、疫苗、以及我国法律法规规定的其他药品零售企业不得经营的药品。非处方药（C错）包括甲类处方药和乙类处方药，零售药店的甲类非处方药（D错）、乙类非处方药（E错）可不凭医师处方销售、购买和使用。